阿司匹林杂质中，能引起过敏反应的是
A. 水杨酸
B. 醋酸苯酯
C. 乙酰水杨酸酐
D. 水杨酸苯酯
E. 乙酰水杨酸苯酯

正确答案：C。乙酰水杨酸酐